流浸膏剂制备多采用
A. 煎煮法
B. 浸渍法
C. 水蒸气蒸馏法
D. 渗漉法
E. 溶解法和稀释法

正确答案：D。渗漉法